倒钩卡环又称为
A. 单臂卡环
B. 双臂卡环
C. 下返卡环
D. 三臂卡环
E. 多臂卡环

正确答案：C。下返卡环

解析：倒钩卡环：用于倒凹区在支托的同侧下方的基牙，又称下返卡环。掌握“局部义齿固位体”知识点。